足月儿生后第1小时内呼吸频率是
A. 20～30次/分
B. 40～50次/分
C. 60～80次/分
D. 90～100次/分
E. 100～110次/分

正确答案：C。60～80次/分

解析：足月儿生后第1小时内呼吸频率约为60～80次/分（C对）。新生儿时期的呼吸频率约为40～50次/分（B错）。20～30次/分（A错）是1～7岁小儿的呼吸频率。